维持组织液生成量与回流量平衡的机制是
A. 多余的生成部分经毛细淋巴管回流
B. 主要受局部代谢产物的调节
C. 毛细血管交替性开放和关闭
D. 改变毛细血管前后阻力比
E. 毛细血管通透性发生改变

正确答案：D。改变毛细血管前后阻力比

解析：在生理状态下，组织液生成和回流处于动态平衡状态，而这种平衡取决于毛细血管血压、组织液静水压、血浆胶体渗透压和组织液胶体渗透压。其中，毛细血管血压和组织液胶体渗透压是促使液体由毛细血管内向外滤过的力量，而组织液静水压和血浆胶体渗透压则是促使液体由毛细血管外向内重吸收的力量。滤过的力量和重吸收的力量之差，称为有效滤过压。在毛细血管动脉端，血管内有效滤过压大于血管外，液体滤过毛细血管组织液生成；在毛细血管静脉端，血管外有效滤过压大于血管内，组织液重吸收回流入毛细血管。且组织液的生成部分90%经毛细血管静脉端回流，只有10%经淋巴系统回流（D对A错）。毛细血管交替性开放和关闭（C错）是微循环的自身调节，以满足机体代谢需求，受局部代谢产物的调节（B错）。毛细血管通透性发生改变（E错）只是影响组织液生成的一个因素，正常情况下毛细血管通透性对蛋白质几乎不通透，但在感染、过敏等情况下，毛细血管通透性增高，导致血浆蛋白随液体渗出毛细血管，使有效滤过压增高，最终导致组织液生成增多。